独语，病因多为
A. 热扰心神
B. 痰火扰心
C. 风痰阻络
D. 心气不足
E. 心阴大伤

正确答案：D。心气不足

解析：独语是指自言自语，喃喃不休，见人语止，首尾不续者，多因心气不足，神失所养，或气郁痰阻，蒙蔽心神所致。（D对）。热扰心神（A错）可见谵语，表现为神识不清，语无伦次，声高有力，属实证。痰火扰心（B错）可见狂言，表现为精神错乱，语无伦次，狂躁妄言。风痰阻络（C错）可见语謇，表现为神志清楚，思维正常，但语言不流利，或吐字不清，每与舌强并见。心阴大伤（E错）可见郑声，表现为神识不清，语言重复，时断时续，语声低弱模糊。